慢性再障的治疗首选
A. 丙酸睾丸酮肌肉注射
B. 造血干细胞移植
C. 维生素B₁₂肌注
D. 抗胸腺球蛋白
E. 肾上腺糖皮质激素口服

正确答案：A。丙酸睾丸酮肌肉注射

解析：丙酸睾丸酮肌肉注射（A对）为雄激素促造血治疗的一种，适用于全部AA（再生障碍性贫血），是慢性再障首选的治疗方法；造血干细胞移植（P550）（B错）及抗胸腺球蛋白（P549）（D错）主要用于SAA（重型再生障碍性贫血）；维生素B₁₂肌注（P546）（C错）主要用于巨幼细胞贫血；肾上腺糖皮质激素（P558）（E错）主要用于自身免疫性溶血性贫血、遗传性球形细胞增多症等。